与龋病发生密切相关的是
A. 脑膜奈瑟菌
B. 福氏志贺菌
C. 白假丝酵母菌
D. 幽门螺旋杆菌
E. 变异链球菌

正确答案：E。变异链球菌

解析：本题考查致龋微生物。与龋病发生密切相关的是变异链球菌（E对）。变异链球菌可以造成啮齿类动物和灵长类动物实验性龋，与人类龋病密切相关。脑膜奈瑟菌（A错）、福氏志贺菌（B错）、白假丝酵母菌（C错）、幽门螺旋杆菌（D错）与龋病的发生关联不大。